寒热往来见于下列哪种证候
A. 表寒
B. 里寒
C. 表热
D. 里热
E. 半表半里

正确答案：E。半表半里

解析：外感病邪至半表半里阶段时，正邪相争，正胜则发热，邪胜则恶寒，故恶寒与发热交替发作，发无定时（E对）。风寒表证（A错）的寒热特点为恶寒明显而发热轻。里寒证（B错）的寒热特点为但寒不热。风热表证（C错）的寒热特点为发热重恶寒轻。里热证（D错）的寒热特点为但热不寒。